生姜和肉豆蔻均有的功效是
A. 涩肠
B. 发表
C. 温中
D. 止咳
E. 止汗

正确答案：C。温中

解析：本题考查的是生姜和肉豆蔻的功效。生姜和肉豆蔻共有的功效是温中（C对）。生姜：【功效】发汗解表，温中止呕，温肺止咳（D错）。肉豆蔻：【功效】涩肠（A错）止泻，温中行气。紫苏：【功效】发表（B错）散寒，行气宽中，安胎，解鱼蟹毒。白术：【功效】补气健脾，燥湿利水，止汗（E错），安胎。